嘧啶核苷酸补救途径的主要酶是
A. 尿苷激酶
B. 嘧啶磷酸核糖转移酶
C. 胸苷激酶
D. 胞苷激酶
E. 氨基甲酰磷酸合成酶

正确答案：B。嘧啶磷酸核糖转移酶